根据《医疗机构制剂注册管理办法（试行）》，下列可以申报医疗机构制剂的是
A. 本院临床短缺的含有麻醉药品的口服止咳糖浆
B. 本院临床需要但市场没有供应的中药注射剂
C. 本院招标采购中标产品但市场供应不足的低价药
D. 本院临床需要但市场没有供应的儿科用止咳糖浆
E. 本院临床需要但市场上没有供应的中药、化学药组成的复方止咳糖浆

正确答案：D。本院临床需要但市场没有供应的儿科用止咳糖浆

解析：本题考查的是医疗机构配制制剂品种范围。根据《医疗机构制剂注册管理办法（试行）》，下列可以申报医疗机构制剂的是本院临床需要但市场没有供应的儿科用止咳糖浆（D对）。医疗机构配制制剂品种范围：医疗机构配制的制剂，应当是本单位临床需要而市场上没有供应的品种。这里的“市场上没有供应的品种”应当包括国内尚未批准上市及虽批准上市但某些性质不稳定或有效期短的制剂，市场上不能满足的不同规格、容量的制剂，临床常用而疗效确切的协定处方制剂，其他临床需要的以及科研用的制剂等（AC错）。根据《医疗机构制剂注册管理办法（试行）》，有下列情形之一的，不得作为医疗机构制剂申报：市场上已有供应的品种；含有未经国家药品监督管理部门批准的活性成分的品种；除变态反应原外的生物制品；中药注射剂（B错）；中药、化学药组成的复方制剂（E错）；医疗用毒性药品、放射性药品；其他不符合国家有关规定的制剂。《麻醉药品和精神药品管理条例》第43条规定，对临床需要而市场无供应的麻醉药品和精神药品，待有医疗机构制剂许可证和印鉴卡的医疗机构需要配制制剂的，应当经所在地省级药品监督管理部门批准。